女，55岁。垂体腺瘤切除术后1小时。查体：P96次/分，R30次/分，BP110/55mmHg，神志清楚。可采取的体位是
A. 15°～30°头高脚低斜坡卧位
B. 下肢抬高15°～20°
C. 侧卧位
D. 平卧位
E. 高半坐位

正确答案：A。15°～30°头高脚低斜坡卧位

解析：手术后，应根据麻醉及病人的全身状况、术式、疾病的性质等选择体位，使病人处于既舒适又便于活动的体位。患者垂体腺瘤切除术为颅脑手术，且无休克或昏迷，术后可采取15°～30°头高脚低斜坡卧位（A对）降低颅内血管压力，有利于病人术后恢复。下肢抬高15°～20°（B错）主要用于休克的病人，采取此种体位有以利于促进静脉回流及维持有效循环血量。侧卧位（C错）主要用于肥胖的病人，采取此种体位有利于病人的呼吸和静脉回流。平卧位（D错）主要用于全身麻醉尚未苏醒的病人，而该患者神志清楚，麻醉苏醒良好，不为此种体位的适应症。高半坐位（E错）主要用于颈、胸部手术的患者，有利于术后呼吸及有效引流。